通常反映社会经济发展水平的指标是
A. 人均收入
B. GDP/人均GDP
C. 出生率
D. 死亡率
E. 平均期望寿命

正确答案：B。GDP/人均GDP